男孩，6个月。面色苍白2个月就诊，患儿仅吃母乳，近半个月面色苍白，活动减少，血象：MCHC30%，MCH25pg，MCV65fl，PLT156×10⁹/L。患儿的诊断应考虑是
A. 巨幼细胞性贫血
B. 缺铁性贫血
C. 营养性混合性贫血
D. 再生障碍性贫血
E. 急性白血病

正确答案：B。缺铁性贫血

解析：6个月男婴儿（缺铁性贫血多见年龄），仅吃母乳（缺铁性贫血诱因），近半月面色苍白，活动减少（缺铁性贫血一般表现），血象MCV65fl，MCH25pg，MCHC30%（小细胞低色素性贫血），根据患者的临床表现和实验室检查，应考虑的诊断是缺铁性贫血（B对）。婴儿期体格生长十分迅速，需大量各种营养素满足其生长，但婴儿的消化功能尚未成熟，如果加辅食不当易发生消化紊乱和营养不良等疾病很容易发生缺铁性贫血。巨幼细胞性贫血（A错）血象大细胞性贫血。营养性混合性贫血（七版诸福棠实用儿科学P1725）（C错）兼有大小细胞贫血的特点，是由于饮食中同时缺乏铁和维生素B₁₂或叶酸等造血物质所致。再生障碍性贫血（D错）表现为发热、贫血和出血，肝、脾、淋巴结不肿大，血象呈全血细胞减少，表现均为正细胞性贫血，骨髓有核细胞增生低下，无幼稚白细胞增生。急性白血病（E错）的贫血表现均为正细胞性贫血。